根据中国营养学会推荐，孕妇和乳母的每日元素钙摄入推荐量是
A. 2000～4000mg
B. 50mg
C. 100mg
D. 500～600mg
E. 1000～1200mg

正确答案：E。1000～1200mg

解析：本题考查钙剂的使用。1000～1200mg（E对）为中国营养学会推荐，孕妇和乳母的每日元素钙摄入推荐量。中国营养学会推荐的每日膳食钙摄入量为：0～6个月300mg，7～12个月400mg，1～3岁600mg，4～10岁800mg，青少年1000mg，孕妇和乳母1000～1200mg。